《中国药典》2010年版对药物制剂稳定性加速试验温度和湿度的要求是
A. 温度40℃±2℃，相对湿度75%±5%
B. 温度60℃±2℃，相对湿度75%±5%
C. 温度25℃±2℃，相对湿度60%±10%
D. 温度20℃±2℃，相对湿度60%±10%
E. 温度25℃±2℃，相对湿度75%±5%

正确答案：A。温度40℃±2℃，相对湿度75%±5%

解析：本题考查药品稳定性试验指导原则。加速试验是在加速条件下进行，其目的是通过加速药物制剂的化学或物理变化，探讨药物制剂的稳定性，为处方设计、工艺改进、质量研究、包装改进、运输、贮存提供必要的资料。实验条件：温度温度40℃±2℃、相对湿度75%±5%（A对）的条件下放置6个月。检测包括初始和末次的3个时间点（如0、3、6个月）。温度25℃±2℃，相对湿度60%±10%（C错）是长期试验的实验条件。